现代经济学认为，健康是一种
A. 基本人权
B. 收益
C. 利润
D. 人力投资
E. 固定成本

正确答案：D。人力投资